关于T、B细胞免疫耐受的特点正确的叙述是
A. 诱导T细胞耐受所需时间长，B细胞短
B. 诱导T细胞耐受维持时间短，B细胞长
C. 高剂量TD-Ag不能使T、B细胞产生耐受
D. 低剂量TD-Ag仅能使T细胞产生耐受，不能使B细胞产生耐受
E. 低剂量的TI-Ag能使T、B细胞均产生耐受

正确答案：D。低剂量TD-Ag仅能使T细胞产生耐受，不能使B细胞产生耐受